向一种高分子囊材溶液中加入凝聚剂制备微囊的方法为
A. 单凝聚法
B. 复凝聚法
C. 改变温度法
D. 液中干燥法
E. 溶剂-非溶剂法

正确答案：A。单凝聚法

解析：本题考查单凝聚法。单凝聚法（A对）是在高分子囊材溶液中加入凝聚剂以降低高分子溶解度使之凝聚成囊的方法。